下列解热镇痛抗炎药中，属于选择性诱导型环氧酶抑制药的有
A. 美洛昔康
B. 阿司匹林
C. 吡罗昔康
D. 塞来昔布
E. 吲哚美辛

正确答案：A、C、D。美洛昔康；吡罗昔康；塞来昔布

解析：本题考查选择性诱导型环氧酶抑制药。美洛昔康（A对）、吡罗昔康（C对）、塞来昔布（D对）为选择性诱导型环氧酶抑制药；阿司匹林（B错）为水杨酸类解热镇痛抗炎药；吲哚美辛（E错）为芳基乙酸类解热镇痛抗炎药，均对环氧酶无选择性。